编制去死因寿命表的关键是
A. L’X
B. P’X
C. mX
D. eX
E. r’X

正确答案：B。P’X

解析：本题考查去死因寿命表的编制。编制去死因寿命表的关键是求得去某死因后各年龄组生存概率P’x（B对ACDE错）。